与药物的消除速率有关的因素包括
A. 药物的表观分布容积
B. 药物的半衰期
C. 药物的生物利用度
D. 药物与组织的亲和力
E. 药物透过血脑屏障的能力

正确答案：A、D、E。药物的表观分布容积；药物与组织的亲和力；药物透过血脑屏障的能力

解析：本题考查清除率。与药物的消除速率有关的因素包括：药物的表观分布容积（A对）、药物与组织的亲和力（D对）、药物透过血脑屏障的能力（E对）；生物半衰期（B错）、生物利用度（C错）均与药物的消除速率无关。